在对鱼际肌神经支配的描述中，正确的是
A. 均由尺神经支配
B. 均由正中神经支配
C. 拇收肌、拇对掌肌由尺神经支配，拇短屈肌由正中神经支配
D. 拇短伸肌由正中神经支配，拇短屈肌、拇收肌、拇对掌肌由尺神经支配
E. 拇短展肌、拇短屈肌、拇对掌肌由正中神经支配，拇收肌由尺神经支配

正确答案：E。拇短展肌、拇短屈肌、拇对掌肌由正中神经支配，拇收肌由尺神经支配

解析：正中神经发出返支支配除拇收肌以外的鱼际肌群，即拇短展肌、拇短屈肌、拇对掌肌，尺神经深支分布于小鱼际肌、拇收肌（E对）。